下列关于复发性脱位临床表现的说法不正确的是
A. 可为单侧或双侧发生
B. 大开口时，下颌骨突然不能自如运动
C. 前牙不能闭合
D. 其临床表现与翼外肌功能亢进相同
E. X线片可见髁突脱位于关节结节前上方

正确答案：D。其临床表现与翼外肌功能亢进相同

解析：复发性脱位可为单侧或双侧。在大开口时，患者突然感到下颌骨不能自如运动，前牙不能闭合，其临床表现与急性前脱位相同。根据病史和临床可作出诊断。X线片可见髁突脱位于关节结节前上方。掌握“颞下颌关节脱位”知识点。